浅龋最常用的常规诊断方法是
A. 温度刺激试验
B. 视诊法
C. 透照法
D. X线检查
E. 叩诊法

正确答案：D。X线检查

解析：本题考查浅龋最常用的常规诊断方法。浅龋指龋损局限于牙釉质的龋病，属于龋齿的早期阶段，由于病损轻微临床不易诊断，借助于X线片可发现浅龋部位与正常釉质相比呈低密度影像，尚可发现隐秘部位的龋损，因此X线检查是浅龋最常用的常规诊断方法（D对）。温度刺激试验不能用来诊断浅龋，因为浅龋患牙对温度反应与正常牙相同（A错）。视诊法可以诊断窝沟龋和平滑面龋，但对于隐蔽部位的龋损不易诊断（B错）。透照法对检查前牙邻面龋洞甚为有效（C错）。叩诊法用于检查根尖周病变（E错）。